只有实质细胞而没有间质的恶性肿瘤是
A. 乳腺髓样癌
B. 印戒细胞癌
C. 恶性黑色素瘤
D. 横纹肌肉瘤
E. 绒毛膜癌

正确答案：E。绒毛膜癌

解析：绒毛膜癌（E对）的癌组织由分化不良的似细胞滋养层和似合体细胞滋养层两种实质细胞组成，无间质血管。乳腺髓样癌（二版八年制病理学P376）（A错）由明显异型的大细胞组成，融合成片，癌细胞巢之间间质较少，有明显淋巴细胞浸润。印戒细胞癌（P97）（B错）由印戒细胞组成，有间质成分，印戒细胞指黏液聚积在癌细胞内，将核挤向一侧，使癌细胞呈印戒状。恶性黑色素瘤（P102）（C错）的癌细胞可呈巢状、条索状、腺样排列，有间质成分。横纹肌肉瘤（D错）由不同分化阶段的横纹肌细胞组成，有间质成分。